根据《药品不良反应报告和检测管理办法》，国家药品监督管理部门根据药品不良反应监测中心的分析评价结果，采取的处理方式有
A. 责令修改药品说明书
B. 暂停生产，销售和使用该药品
C. 对不良反应大的药品应当撤销药品批准证明文件，并予以公布
D. 对已被撤销批准证明文件的药品，要求将已生产的药品退回药品生产企业销毁处理
E. 对已被撤销批准证明文件的药品，要求将已销售的药品退回药品生产企业销毁处理

正确答案：A、B、C。责令修改药品说明书；暂停生产，销售和使用该药品；对不良反应大的药品应当撤销药品批准证明文件，并予以公布

解析：本题考查的是药品不良反应监测机构对药品不良反应的评价与控制。根据《药品不良反应报告和检测管理办法》，国家药品监督管理部门根据药品不良反应监测中心的分析评价结果，采取的处理方式有责令修改药品说明书（A对）；暂停生产，销售和使用该药品（B对）；对不良反应大的药品应当撤销药品批准证明文件，并予以公布（C对）。药品不良反应监测机构对药品不良反应的评价与控制：省级药品不良反应监测机构应当每季度对收到的药品不良反应报告进行综合分析，提取需要关注的安全性信息，并进行评价，提出风险管理建议，及时报省级药品监督管理部门、卫生行政部门和国家药品不良反应监测中心。省级以上药品不良反应监测机构根据分析评价工作需要，可以要求药品上市许可持有人、药品生产、经营企业和医疗机构提供相关资料，相关单位应当积极配合。省级药品监督管理部门根据分析评价结果，可以采取暂停生产、销售、使用和召回药品等措施，并监督检查，同时将采取的措施通报同级卫生行政部门。国家药品不良反应监测中心应当每季度对收到的严重药品不良反应报告进行综合分析，提取需要关注的安全性信息，并进行评价，提出风险管理建议，及时报国家药品监督管理部门和卫生行政部门。国家药品监督管理部门根据药品分析评价结果，可以要求企业开展药品安全性、有效性相关研究。必要时，应当采取责令修改药品说明书，暂停生产、销售、使用和召回药品等措施，对不良反应大的药品，应当撤销药品批准证明文件，并将有关措施及时通报卫健委。